大面积烧伤休克期患者出现烦躁，多由于
A. 疼痛
B. 精神紧张
C. 早期毒血症
D. 中枢神经系统异常
E. 血容量不足

正确答案：E。血容量不足

解析：大面积烧伤病人因体液大量丢失导致低血容量休克，表现为严重口渴，烦躁不安等行为，这种常常提示为休克严重。掌握“火器伤、热烧伤”知识点。